下列哪项属于青少年自杀的保护因素
A. 父母分居、离异和一方或双方死亡
B. 家庭温馨、和睦，凝聚力大
C. 同伴间的暴力行为
D. 违禁药物滥用
E. 缺乏学校支持环境

正确答案：B。家庭温馨、和睦，凝聚力大